充分体现实施人类辅助生殖技术的严防商品化原则的是
A. 医务人员对捐赠精子、卵子、胚胎者，须告知其有关权利、义务等事宜
B. 医务人员与捐赠精子、卵子、胚胎者保持互盲，与受方夫妇及出生的后代保持互盲
C. 医务人员不得对单身女性实施人工辅助生殖技术，不得对任何人实施代孕技术
D. 医务人员不得将人工辅助生殖技术应用于有可能自然生育的夫妇
E. 医务人员运用人工辅助生殖技术应接受医学伦理委员会的审查监督

正确答案：D。医务人员不得将人工辅助生殖技术应用于有可能自然生育的夫妇